心身疾病诊断应注意的问题
A. 确定躯体症状
B. 寻找致病的心理社会因素
C. 排除躯体疾病和神经症的诊断
D. 关注疾病症状与心理应激反应的相似性
E. 以上说法均正确

正确答案：E。以上说法均正确

解析：心身疾病诊断应注意的问题：①确定躯体症状；②寻找致病的心理社会因素；③排除躯体疾病和神经症的诊断；④关注疾病症状与心理应激反应的相似性。掌握“心身疾病”知识点。